女性，26岁。左颈及腋下有无痛性肿块，体检时发现在左侧颈部、锁骨上和腋窝等处有肿大的无痛性孤立的淋巴结。以下哪些诊断方法有助于判断该患者的疾病程度
A. 肝脾B超
B. 淋巴管造影
C. 骨髓活检
D. 头颅CT
E. 外周血细胞计数

正确答案：C。骨髓活检